HPV不经过哪种途径传播
A. 垂直传播
B. 直接接触
C. 间接接触
D. 性接触
E. 呼吸道

正确答案：E。呼吸道

解析：HPV主要通过直接接触，尤其是性关系接触感染者的病损部位传播，属于性传播疾病（STD）之一。另外，间接接触被病毒污染的物品以及新生儿经产道，均可被感染。掌握“狂犬病、人乳头瘤病毒”知识点。